牙本质的胶原纤维主要为
A. Ⅰ型胶原
B. Ⅱ型胶原
C. Ⅲ型胶原
D. Ⅳ型胶原
E. Ⅴ型胶原

正确答案：A。Ⅰ型胶原

解析：有机物中胶原蛋白约占18%，为所有有机物的90%以上。主要为Ⅰ型胶原，还有少量Ⅲ型和Ⅴ型胶原。掌握“牙本质”知识点。